在银汞合金充填中使用固位钉
A. 应与牙齿长轴相平行
B. 应放置尽可能靠近牙髓处
C. 应与牙齿表面相平行
D. 数量越多越好

正确答案：C。应与牙齿表面相平行

解析：本题考查固位钉的使用。髓腔的外形与牙冠外形相似，使用固位钉时，固位钉应与牙齿表面相平行，以防穿髓（C对）。在前牙时若固位钉与牙体长轴相平行，易导致穿髓（A错）。固位钉应放置尽可能远离牙髓处，放置靠近牙髓处（B错）易损伤牙髓组织。固位钉数量应2～3个，数量不是越多越好，其数量过多易引起牙折（D错）。